普通型流行性脑脊髓膜炎临床分期不包括
A. 恢复期
B. 败血症期
C. 前驱期
D. 脑膜炎期
E. 发热期

正确答案：E。发热期

解析：普通型流行性脑脊髓膜炎临床分期包括前驱期（上呼吸道感染期）（C对）、败血症期（B对）、脑膜炎期（D对）、恢复期（A对）。发热期（E错，为本题正确答案）在流行性脑脊髓膜炎各型分期中均不存在。